参与构成葡萄糖耐量因子的微量元素是
A. 铁
B. 锌
C. 铜
D. 铬
E. 硒

正确答案：D。铬

解析：本题考查参与构成葡萄糖耐量因子的微量元素。铬（D对ABCE错）作为葡萄糖耐量因子的主要组成成分，膳食补充三价铬对糖尿病有积极的预防和辅助治疗作用。